抽样调查较普查有许多优点，下列哪项不是其优点
A. 节省人力
B. 适宜于调查患病率低的疾病
C. 节约时间
D. 工作易做得细致
E. 节约物力

正确答案：B。适宜于调查患病率低的疾病

解析：本题考查抽样调查的优点。抽样调查具有节省时间（C对）、人力（A对）和物力（E对）资源等优点，同时由于调查范围小，调查工作易于做得细致（D对）。但患病率低的疾病（B错，为本题正确答案）由于需要较大的样本量，因此不适用于抽样调查。